滴丸的溶散时限为
A. 5min
B. 15min
C. 30min
D. 45min
E. 60min

正确答案：C。30min

解析：本题考查的是丸剂的溶散时限。滴丸的溶散时限为30min（C对）。包衣滴丸规定在1小时内全部溶散；小蜜丸、水蜜丸和水丸规定在1小时内全部溶散（E错）；浓缩丸和糊丸规定在2小时内全部溶散。蜡丸照崩解时限检查法片剂项下的肠溶衣片检查法检查，在盐酸溶液中（9→1000）检查2小时，不得有裂缝、崩解或软化现象，再在磷酸盐缓冲液（pH6.8）中检查，1小时内应全部崩解。